淋巴系统由＿组成
A. 由淋巴结和淋巴管组成
B. 由淋巴管淋巴干和淋巴导管组成
C. 由淋巴管道，淋巴器官和淋巴组织组成
D. 由淋巴管，脾组成
E. 无

正确答案：C。由淋巴管道，淋巴器官和淋巴组织组成

解析：淋巴系统由淋巴管道、淋巴组织和淋巴器官共同组成（C对）。淋巴器官包括淋巴结、胸腺、脾和扁桃体，其中脾是人体最大的淋巴器官。淋巴管道可分为毛细淋巴管、淋巴管、淋巴干、淋巴导管（B错）。